伸肘关节的肌
A. 肱肌
B. 肱三头肌
C. 肱桡肌
D. 喙肱肌
E. 无

正确答案：B。肱三头肌

解析：伸肘关节的肌是肱三头肌（B对）。肱肌（A错）的作用是屈肘关节。肱桡肌（C错）的作用是屈肘关节和旋后处于旋前位的前臂。喙肱肌（D错）的作用是前屈和内收肩关节。